氯甲醚可引起的法定职业肿瘤为
A. 肺癌
B. 皮肤癌
C. 白血病
D. 肾脏肿瘤
E. 胃癌

正确答案：A。肺癌

解析：本题考查氯甲醚的致癌种类。氯甲甲醚遇水或其气体与水蒸气相遇，水解后还能合成双氯甲醚。双氯甲醚较稳定，在空气中存留时间长。在实际生产中，两者难以严格区分，统称为氯甲醚类，对于呼吸道黏膜均有强烈刺激作用。氯甲醚类作业工人的肺癌（A对BCDE错）发病率显著高于非接触人群且呈剂量-反应关系。所引起的肺癌多为燕麦细胞（未分化小细胞）型肺癌，恶性程度高。